牙源性颌骨囊肿来源于
A. 牙周膜及颌骨牙槽突的结缔组织
B. 表皮基底层产生黑色素的色素细胞
C. 由成牙组织或牙的上皮或上皮剩余演变而来的
D. 颞部疖痈以及颞部损伤继发感染
E. 耳源性感染如化脓性中耳炎、颞乳突炎

正确答案：C。由成牙组织或牙的上皮或上皮剩余演变而来的

解析：颌骨囊肿可根据组织来源和发病部位而分类。由成牙组织或牙的上皮或上皮剩余演变而来的，称为牙源性颌骨囊肿。掌握“牙龈瘤”知识点。